盐酸普鲁卡因溶液颜色变黄的原因是
A. 水解
B. 聚合
C. 异构化
D. 氧化
E. 脱羧

正确答案：D。氧化

解析：本题考查药物降解途径。氧化（D对）是盐酸普鲁卡因溶液颜色变黄的原因。盐酸普鲁卡因的水解可作为这类药物的代表。水解时，盐酸普鲁卡因在酯键处断开，分解成对氨基苯甲酸与二乙氨基乙醇，此分解产物无明显的麻醉作用；对氨基苯甲酸还可继续发生氧化，生成有色物质，同时在一定条件下又能发生脱羧反应，生成有毒的苯胺，苯胺又可继续被氧化，这是盐酸普鲁卡因注射液变黄的主要原因。